患者，女性，22岁，4天前因劳累出现左侧下后牙龈胀痛，进食吞咽时加重，昨日起出现局部自发性跳痛，面部肿胀，张口受限，伴发热。检查：左侧颊部肿胀，局部皮温增高，压痛明显，局限于咬肌前缘处，并及凹陷性水肿；张口度约二指，左下颌第三磨牙近中低位阻生，牙龈瓣覆盖其上，充血肿胀，并见糜烂，挤压局部少量脓液溢出，同侧第一磨牙前庭沟丰满充血，压痛存在，第一磨牙叩诊（-），无松动，无龋坏，未及牙周袋。该患者最有可能的诊断是左侧第三磨牙冠周炎。该患者待急性炎症控制后的治疗应以下列哪一项为主：
A. 拔除左侧下颌第三磨牙
B. 下颌骨死骨刮除术
C. 左侧下颌第三磨牙作牙髓治疗
D. 左侧下颌第三磨牙作牙周治疗
E. 继续抗炎治疗

正确答案：A。拔除左侧下颌第三磨牙

解析：本题考查智齿冠周炎的治疗。第三磨牙近中低位阻生，引起智齿冠周炎，炎症控制后应及时拔除病源牙（A对），以防止再复发。病变发展为颌骨骨髓炎，下颌骨有死骨形成时，应行死骨摘除及病灶清除术（B错）。没有保留价值的智齿，无需进行牙髓治疗（C错）和牙周治疗（D错）。急性炎症控制后，根据患者局部炎症和全身反应及有无其他并发症，选择是否继续抗炎治疗（E错）。